女，48岁，外阴瘙痒伴灼热感3天。妇科检查见外阴红肿，小阴唇及阴道黏膜表面有白色凝乳状物覆盖。该患者首先考虑
A. 细菌性阴道炎
B. 滴虫性阴道炎
C. 老年性阴道炎
D. 前庭大腺炎
E. 假丝酵母菌性阴道炎

正确答案：E。假丝酵母菌性阴道炎

解析：患者外阴瘙痒伴灼热感3天，检查见外阴红肿、小阴唇内侧及阴道黏膜表面有白色凝乳状物覆盖（假丝酵母菌性阴道炎分泌物典型特征），考虑为外阴阴道假丝酵母菌病（E对）。细菌性阴道炎（A错）分泌物呈灰白色、均匀一致、稀薄状，常黏附于阴道壁，但容易从阴道壁拭去，带有鱼腥臭味。滴虫阴道炎（B错）主要症状是外阴瘙痒，阴道分泌物异常，分泌物典型特点为稀薄脓性、泡沫状、有异味。老年性阴道炎（C错）常见于绝经后的老年妇女，因局部抵抗力降低，致病菌易入侵繁殖引起炎症，可见阴道分泌物增多、稀薄、呈淡黄色，严重者呈脓血性白带，有臭味。前庭大腺炎（D错）起病急，多为一侧，检查可见局部皮肤红肿、压痛明显，患侧前庭大腺开口处有时可见白色小点。若感染进一步加重，脓肿形成并快速增大，可触及波动感。